女性，50岁。单侧腮腺无痛性进行性肿大6年。有类风湿性关节炎史，γ球蛋白增高，活检有大量淋巴细胞。最可能的诊断是
A. 慢性化脓性腮腺炎
B. 舍格伦综合征
C. 腮腺多形性腺瘤
D. 腮腺淋巴结核
E. 腮腺放线菌病

正确答案：B。舍格伦综合征

解析：本题考查舍格伦综合征。根据题干，患者单侧腮腺无痛性进行性肿大，有类风湿性关节炎史，γ球蛋白增高，活检有大量淋巴细胞，这些均为舍格伦综合征（B对）的特征性表现。慢性化脓性腮腺炎（A错）主要表现为腮腺反复肿胀，疼痛明显，挤压腺体可见导管口有脓液或胶冻状液体溢出。腮腺多形性腺瘤（C错）界限清楚，质地中等，扪诊呈结节状，肿瘤由肿瘤性上皮组织和黏液样或软骨样间质组成。腮腺淋巴结核（D错）为结核杆菌感染引起，病原菌检测可查出结核杆菌，临床表现可有冷脓肿。腮腺放线菌病（E错）在腮腺上呈板结样坚硬、周界不清肿块，皮肤成暗棕红色，全身症状不明显，脓液中可见硫磺颗粒。